子宫切除后，最易损伤输尿管的步骤是
A. 处理骨盆漏斗韧带
B. 处理子宫圆韧带
C. 处理子宫血管及子宫主骶韧带
D. 缝合后腹膜
E. 缝合阴道两侧角及结扎膀胱子宫韧带

正确答案：C。处理子宫血管及子宫主骶韧带

解析：输尿管起自肾盂，开口于膀胱，分为腰部、盆部和壁内部。输尿管盆部于骶髂关节处横跨髂内、外动脉分叉处，即骨盆漏斗韧带（A错）侧后4～6cm，进入骨盆。在腹膜后盆壁内继续下行，于子宫阔韧带基底部向前内方行，于子宫颈外侧约2cm处，在子宫动脉下方与之交叉穿过，又经阴道侧穹窿顶端约1.5cm处绕向前方，穿越主韧带前方进入膀胱壁，在壁内斜行1.5～3cm，开口于膀胱三角区的外侧角。输尿管与子宫血管及子宫主骶韧带（C对）的解剖关系最密切，子宫切除时，最易受损。输尿管虽紧贴后腹膜，但易辨别，在缝合后腹膜（D错）时有可能被卷入而损伤。输尿管距阴道侧穹隆1.5cm，缝合阴道两侧角及结扎膀胱子宫韧带（E错）可能损伤输尿管。圆韧带（B错）起自宫角的前面，在阔韧带前叶的覆盖下向前外侧走形，与输尿管解剖关系不密切。